普萘洛尔是
A. α受体激动药
B. α受体阻断药
C. β受体激动药
D. β受体阻断药
E. M受体激动药

正确答案：D。β受体阻断药

解析：本题考查普萘洛尔。普萘洛尔是β受体阻滞剂（D对）。普萘洛尔为非选择性β受体阻断剂，主要用于治疗室上性心律失常。对交感神经兴奋性增高、甲状腺功能亢进及嗜铬细胞瘤等引起的窦性心动过速效果好。α受体激动药（A错）有去甲肾上腺素、间羟胺等。α受体阻断剂（B错）有酚妥拉明、酚苄明等。β受体激动剂（C错）有异丙肾上腺素、沙丁胺醇等。M受体激动药（E错）有毛果芸香碱等。